糖尿病微血管病变的病理特点是
A. 毛细血管动脉粥样硬化，管腔狭窄
B. PAS阳性物质沉着于内皮下，毛细血管基底膜增厚
C. 毛细血管钙化，通透性降低
D. 毛细血管的微血栓形成，血液流速慢
E. 毛细血管的内皮细胞受损

正确答案：B。PAS阳性物质沉着于内皮下，毛细血管基底膜增厚

解析：糖尿病微血管病变是指糖尿病病人微动脉、毛细血管和微静脉的病变，病变的特征是微血管基底膜增厚。微血管病变为糖尿病特征性的并发症，部分Ⅱ型糖尿病病人在糖尿病症状出现前已有微血管病变存在（B对，A错）。血管钙化是动脉粥样硬化、高血压、糖尿病血管病变、血管损伤、慢性肾病和衰老等普遍存在的共同的病理表现。糖尿病微血管病变是由于微血管通透性的增加，大分子蛋白质可经做血管外渗和沉积于管壁（C错）。不稳定型心绞痛发生冠脉内不稳定的粥样斑块继发病理改变，如斑块内出血、斑块纤维帽破裂、血小板聚集形成血栓及（或）刺激冠状动脉痉挛，使局部心肌血流量明显下降，导致缺血性心绞痛，虽然也可因劳力负荷诱发但劳力负荷终止后胸痛并不能缓解（D错）。内皮细胞损伤在微血管病变的发生中起重要作用。反复的内皮细胞死亡和再生可引起基底膜增厚，使血管口径缩小，内壁粗糙，弹性及收缩力减弱。这些改变可导致血流不畅、淤滞，以至阻断，使体内组织处于缺氧状态（E错）。